小脑核不包括
A. 齿状核
B. 栓状核
C. 球状核
D. 顶核
E. 红核

正确答案：E。红核

解析：小脑核位于小脑内部，埋于小脑髓质内，由内侧向外侧依次为顶核（D对）、球状核（C对）、栓状核（B对）和齿状核（A对）。红核（E错，为本题正确选项）属于脑桥核。